房水回流受阻，眼内压增高，视力下降称
A. 青光眼
B. 白内障
C. 近视眼
D. 远视眼
E. 散光眼

正确答案：A。青光眼

解析：青光眼（A对）是指房水回流受阻，眼内压增高，视力下降；白内障（B错）是指晶状体因疾病或创伤而变混浊；近视眼（C错）是指眼轴较长或屈光装置的屈光率过强，使物像落在视网膜前；远视眼（D错）眼轴较短或屈光装置的屈光率过弱，使物像则落在视网膜后。散光眼（E错）是指角膜表面各径线曲率不相等称。